ABO抗原
A. 引起Ⅰ型超敏反应
B. 引起Ⅱ型超敏反应
C. 引起Ⅲ型超敏反应
D. 引起Ⅳ型超敏反应
E. 是Ⅰ型超敏反应的介质

正确答案：B。引起Ⅱ型超敏反应